可抑制粒细胞浸润和白细胞趋化，用于痛风急性发作的药物是
A. 非布索坦
B. 苯溴马隆
C. 秋水仙碱
D. 别嘌醇
E. 碳酸氢钠

正确答案：C。秋水仙碱

解析：本题考查药物的作用特点。秋水仙碱（C对）的作用通过：1.抑制粒细胞浸润和白细胞趋化；2.抑制磷脂酶A₂，减少单核细胞和中性白细胞释放前列腺素和白三烯；3.抑制局部细胞产生IL-6等，从而达到控制关节局部疼痛、肿胀及炎症反应；非布索坦（A错）为XOR抑制剂，作用于XOR氧化酶，减少体内尿酸合成；苯溴马隆（B错）可抑制近端肾小管对尿酸盐的重吸收，使尿酸排出增加；别嘌呤（D错）为黄嘌呤氧化酶（XOR）抑制剂，抑制尿酸合成；碳酸氢钠（E错）可调节酸平衡。